遗传性牙本质发育不全多属于
A. 常染色体隐性遗传病
B. 性染色体显性遗传病
C. 性染色体隐性遗传病
D. 常染色体显性遗传病
E. 又被称为特纳牙

正确答案：D。常染色体显性遗传病

解析：遗传性牙本质发育不全是一组常染色体遗传病，多为显性遗传。掌握“遗传性牙本质发育不全”知识点。